哪项属于正反馈
A. 腱反射
B. 减压反射
C. 排尿反射
D. 肺牵张反射
E. 对侧伸肌反射

正确答案：C。排尿反射